关于临床根管治疗的疗效评价，以下不符合痊愈的标准的是
A. 无自觉症状
B. 临床检查无异常
C. 牙齿行使功能良好
D. X线片显示根尖周组织影像无异常
E. X线片显示根尖周透射区明显减小

正确答案：E。X线片显示根尖周透射区明显减小

解析：疗效评定标准有以下方面单项的评定指标综合组成评定标准，分为痊愈、有效和无效。痊愈：无自觉症状，临床检查无异常，功能良好。X线片显示根尖周组织影像无异常；有效：无自觉症状，临床检查无异常，功能良好，X线片显示根尖周透射区明显减小；无效：有自觉症状，临床检查异常，功能不好，X线片显示根尖周透射区不变或增大，或术前无根尖病变，术后出现根尖透射区。掌握“疗效评定与牙体修复原则”知识点。